脊髓前索内有
A. 薄束
B. 红核脊髓束
C. 脊髓丘脑前束
D. 楔束
E. 皮质脊髓侧束

正确答案：C。脊髓丘脑前束

解析：薄束（A错）和楔束（D错）位于脊髓后索内。红核脊髓束（B错）在脊髓外侧索内下行。脊髓丘脑前束（C对）位于脊髓前索。皮质脊髓侧束（E错）位于脊髓外侧索后部下行。